不属于足三里主治的是
A. 胃痛、呕吐
B. 乳痈、肠痈
C. 癫狂等神志病
D. 目赤肿痛
E. 虚劳

正确答案：D。目赤肿痛

解析：足三里主治：胃痛、呕吐、腹胀、肠鸣、消化不良、下肢痿痹、泄泻、便秘、痢疾、疳积、癫狂、中风、脚气、水肿、下肢不遂、心悸、气短、虚劳赢瘦，不能治疗眼部疾患（D错，为本题正确选项）。足三里“①主治胃痛、呕吐（A对）噎膈、腹胀、腹泻、痢疾、便秘等胃肠病症；②下肢痿痹；③癫狂等神志病（C对）④乳痈、肠痈（B对）等外科疾患；⑤虚劳诸损，为强壮保健要穴”（E对）。